属于上焦生理功能特点的是
A. 主气的升发
B. 升已而降，若雾露之溉
C. 通行三气
D. 原气之别使
E. 以上都不是

正确答案：B。升已而降，若雾露之溉

解析：《灵枢·决气》：“上焦开发，宣五谷味，熏肤、充身、泽毛，若雾露之溉（B对），是谓气”这是上焦对心肺输布营养至全身的作用形象化的描写与概括，喻指上焦宣发卫气，敷布水谷精微、血和津液的作用，如雾露之灌溉。